女，16岁。发热伴头痛，恶心2天，于8月10日入院。呕吐3次，为胃内容物。查体：T39.6℃，BP120/80mmHg。精神萎靡。定向力差。颈抵抗（+），克氏症及巴氏征均阳性。该患者病变最严重的部位是
A. 大脑皮质和小脑
B. 小脑和丘脑
C. 小脑和脊髓
D. 大脑皮质及丘脑
E. 延髄和桥脑

正确答案：D。大脑皮质及丘脑

解析：患者青少年女性，发热伴头痛，恶心呕吐（提示感染性疾病引起颅内压增高）。查体：T39.6℃（正常腋温36～37℃），BP120/80mmHg（正常血压90～120/60～80mmHg）。精神萎靡，定向力差提示患者大脑皮质受损。颈抵抗（+），克氏症（脑膜刺激征）和巴氏征阳性（提示锥体束病变）（D对）。小脑病变（ABC错）主要表现为身体平衡失调，步基变宽，站立不稳易摔倒。脊髓受损（C错）常表现为病变平面以下感觉运动功能障碍。延髓为人体呼吸、循环调节中枢，延髓病变（E错）后常表现为呼吸和循环功能障碍，患者早期出现生命体征异常。